伸小腿的肌是
A. 股二头肌
B. 胫骨前肌
C. 半膜肌
D. 股四头肌
E. 小腿三头肌

正确答案：D。股四头肌

解析：股二头肌（A错）屈膝、伸髋，使已屈的膝关节旋外。胫骨前肌（B错）伸踝关节，使足内翻。半膜肌（C错）屈膝、伸髋，使已屈的膝关节旋内。股四头肌（D对）屈髋关节和伸膝关节，即伸小腿。小腿三头肌（E错）屈踝关节和膝关节。